患儿，3岁。咳嗽痰多，粘稠难咯，发热面赤，目赤唇红，口苦作渴，烦躁不宁，舌红苔黄，脉滑数。治疗应首选
A. 二陈汤
B. 桑菊饮
C. 桑杏汤
D. 清金化痰汤
E. 麻杏石甘汤

正确答案：D。清金化痰汤

解析：患儿咳嗽痰多，粘稠难咯，当属咳嗽，痰热相结，阻于气道，肺失清肃，肺失宣降，则致咳嗽痰多、粘稠难咯，痰热阻于内，则见粘稠难咯，发热面赤，目赤唇红，口苦作渴，烦躁不宁，舌红苔黄，脉滑数均为痰热之象。治以清金化痰汤，可清肺化痰（D对）。二陈汤善治寒痰、湿痰（A错）。桑菊饮主治风热咳嗽，症见咳嗽不爽，痰黄黏稠伴恶风，发热等表证（B错）。桑杏汤善于治疗外感温燥证，症见咽干鼻燥，干咳无痰，或痰少而黏，舌红，苔薄白而干（C错）。麻杏甘石汤治疗外感风热所致的身热不解，咳嗽喘逆等（E错）。